以下哪项不是年轻恒牙龋齿好发的部位
A. 第一恒磨牙（牙合）面
B. 下颌恒磨牙的颊面
C. 第二恒磨牙（牙合）面
D. 上颌中切牙的唇面
E. 上颌恒磨牙的舌面

正确答案：D。上颌中切牙的唇面

解析：年轻恒牙的好发部位为：第一、二恒磨牙的（牙合）面，邻面（上颌舌面和下颌颊面）；上颌中切牙邻面。掌握“年轻恒牙龋”知识点。